急诊肝衰竭实验室检查一般不会出现的结果是
A. 转氨酶增高
B. 胆红素增高
C. 凝血酶原时间缩短
D. 血肌酐增高
E. 纤维蛋白原减少

正确答案：C。凝血酶原时间缩短

解析：转氨酶一般只存在肝细胞内。当肝细胞受损时，转氨酶便会释放到血液里，使血清转氨酶升高（A对）。肝衰竭时，一方面，肝细胞摄取非结合胆红素能力下降，血非结合胆红素升高；另一方面，细胞内结合胆红素释放入血，血结合胆红素升高，总胆红素升高（B对）。凝血酶原时间反映凝血因子数量、功能。肝衰竭时，凝血因子合成减少，凝血酶原时间延长（C错，为本题正确答案）。肝衰竭时对血肌酐的影响不大，血肌酐可增高（D对）、降低。纤维蛋白原合成主要部位是肝脏，肝衰竭时，纤维蛋白原合成减少（E对）。